男性，62岁，吸烟30年，咳嗽，咳痰6年余，近1年来出现喘息，时轻时重，双肺散在干湿啰音及喘鸣音，痰涂片见大量中性粒细胞，其诊断下列哪项可能性最大
A. 慢性支气管炎
B. 支气管哮喘
C. 肺间质纤维化
D. 支气管扩张症
E. 支气管肺癌

正确答案：A。慢性支气管炎

解析：患者为老年男性，有吸烟史（为慢性支气管炎最重要的环境发病因素），咳嗽、咳痰6年余，近1年来出现喘息，双肺散在干湿啰音及喘鸣音，痰涂片见大量中性粒细胞，考虑诊断为慢性支气管炎（A对）。支气管哮喘（P29）（B错）的主要表现为发作性伴有哮鸣音的呼气性呼吸困难，双肺可闻及广泛哮鸣音，而患者表现为双肺散在干湿啰音及喘鸣音。肺间质纤维化（P90）（C错）属于间质性肺疾病，主要表现为进行性加重的呼吸困难、限制性通气功能障碍伴弥散功能降低、低氧血症，双肺基底部可闻及Velcro啰音，患者并无相关症状。支气管扩张症（P37）（D错）多见于儿童和青年，主要表现为咳大量脓痰、咳血，患者并无相关症状。支气管肺癌（P77-P78）（E错）主要表现为咳嗽、血痰或咯血、发热、体重下降，痰涂片可发现癌细胞，患者并无相关症状和检查结果。